免疫缺陷病患者发生恶性肿瘤的几率比正常人高
A. 50～100倍
B. 100～200倍
C. 100～300倍
D. 200～300倍
E. 500倍

正确答案：C。100～300倍

解析：免疫缺陷病患者发生恶性肿瘤的几率比正常人高100～300倍。掌握“免疫缺陷概述及原发性、获得性免疫缺陷病”知识点。